系统综述的步驟和方法不包括
A. 选题和制定研究方案
B. 检索和收集原始文献
C. 严格评价证据
D. 根据入选标准选择合格的研究
E. 评估入选研究的质量

正确答案：C。严格评价证据